患者45岁，工人，上腹疼痛6年，餐前痛、伴反酸，2小时前发生上腹剧痛，呈持续性，向腰背部放射，查体：板状腹，腹部压痛、反跳痛明显，T38.5℃，白细胞升高，中性粒细胞70%，诊断首先考虑为
A. 慢性胃炎
B. 胃溃疡
C. 胃癌
D. 十二指肠溃疡穿孔
E. 胃黏膜脱垂

正确答案：D。十二指肠溃疡穿孔

解析：本题考查急性胃十二指肠溃疡穿孔的临床表现。患者45岁，工人，上腹疼痛6年，餐前痛、伴反酸（饥饿痛，提示有十二指肠溃疡病史），2小时前发生上腹剧痛，呈持续性，向腰背部放射，查体：板状腹，腹部压痛、反跳痛明显，T38.5℃，白细胞升高，中性粒细胞70%，诊断首先考虑为十二指肠溃疡穿孔（D对）。慢性胃炎（A错）大多数患者无明显症状，可表现为中上腹不适、饱胀、钝痛、烧灼痛等，体征多不明显，有时上腹轻压痛。胃溃疡（B错）上腹痛或不适为主要症状，表现为餐后痛。胃癌（C错）早期病人无明显症状，随病情发展，出现上腹疼痛加重、食欲下降、乏力、消瘦、体重减轻；早期病人多无明显体征，晚期病人可触及上腹部质硬、固定的肿块，锁骨上淋巴结肿大、直肠前凹扪及肿块、贫血、腹水、黄疸。营养不良甚至恶病质等表现。胃黏膜脱垂（E错）可表现为腹痛，常在进餐后诱发，左侧卧位疼痛可减轻。